有苦杏仁味的气体是
A. 氨气
B. 硫化氢
C. 氰化氢
D. 一氧化碳

正确答案：C。氰化氢

解析：本题考查氰化氢的理化性质。氰化氢（C对ABD错），常温常压下为无色气体或液体，有苦杏仁味；易溶于水、乙醇和乙醚。其水溶液呈酸性，称为氢氰酸；易燃，明火、高热能引起燃烧爆炸；其蒸气与空气可形成爆炸性混合物。